治实热积滞，大便秘结的药物是
A. 芒硝
B. 大黄
C. 二者均是
D. 二者均不是

正确答案：C。二者均是

解析：本题考查的是芒硝与大黄的性能特点与主治病证。芒硝与大黄均为攻下药（C对）。芒硝（A错）：【性能特点】本品苦寒沉降，咸能软润，入胃、大肠、三焦经。内服泻热通便，润软燥屎，加速排便，为治实热内结、燥屎坚硬难下之要药；外用能软散坚硬肿块、回乳、清火，为治疮肿、痔疮肿痛所常用。功似大黄，泻热通肠，长于润软、燥结粪便与肿块。既稀软燥结之便，又促肠蠕动而泻热排便，为溶积性泻药，泻热通便力甚强，善治里热燥结之便秘。【主治病证】（1）实热积滞，大便燥结。（2）咽喉肿痛，口舌生疮，目赤肿痛，疮疡，乳痈，肠痈，痔疮肿痛。大黄（B错）：【性能特点】本品苦寒沉降，清泄通利，既入脾、胃、大肠经，又入心、肝经与血分。内服善荡涤胃肠实积、实热而泻热通便，导湿热之邪从大便出而利胆退黄，“釜底抽薪”与除血分热毒而解热毒，泄散血分热毒与瘀血而活血化瘀、凉血止血、消肿。外用善清火、消肿、止痛、解毒而疗疮痈烫伤。泻热通便力甚强，素有“将军”之号。凡便秘属实证或里实证虚者即可酌投，热结便秘兼瘀者尤宜。凡血瘀有热之肿痛或出血者亦可酌投，兼便秘或排便不爽者尤佳。生用泄下力猛，熟用药力较缓，炒炭清散兼收敛。【主治病证】（1）大便秘结，胃肠积滞，湿热泻痢初起。（2）火热上攻之目赤、咽喉肿痛、口舌生疮、牙龈肿痛。（3）热毒疮肿，水火烫伤。（4）血热之吐血、衄血、咯血、便血。（5）瘀血闭经，产后瘀阻腹痛，癥瘕积聚，跌打损伤。（6）湿热黄疸，淋证涩痛。